丹痧的特征是
A. 咳嗽剧烈
B. 发热恶寒
C. 热退疹出
D. 全身布有弥漫性猩红色皮疹
E. 手足心见疹为出齐

正确答案：D。全身布有弥漫性猩红色皮疹

解析：丹痧以皮肤色赤猩红，皮疹细小如沙为主要特征，相当于现代西医学的猩红热（D对）。丹痧可致咽喉肿痛甚则腐烂，可见咳嗽剧烈，但亦可见于肺系其他疾病，非其主要特征（A错）。发热恶寒可见于前驱期属邪侵肺卫证，但非丹痧突出特征（B错）。热退疹出常见于幼儿急疹（C错）。手足心见疹为出齐为麻疹之特征（E错）。